下列药物有效成分为碳酸钙的是
A. 海马
B. 石决明
C. 珍珠
D. 全蝎
E. 斑蝥

正确答案：B、C。石决明；珍珠

解析：本题考查的是石决明与珍珠的有效成分。下列药物有效成分为碳酸钙的是石决明（B对）、珍珠（C对）。石决明【成分】主含碳酸钙及多种氨基酸、壳角质、胆素、微量元素等。尚含少量镁、铁、磷酸根、硅酸根、氯离子及微量碘。珍珠【成分】主含碳酸钙（海水珍珠95.66%，淡水珍珠94.45%）、壳角蛋白（海水珍珠4%，淡水珍珠3.83%）。海马（A错）【成分】刺海马含蛋白质、脂肪、多种氨基酸。另含皮肤黄色素、红色素、蝲蛄素、黑色素。并含乙酰胆碱酯酶、胆碱酯酶、蛋白酶。全蝎（D错）【成分】含蝎毒素，为一种含碳、氢、氧、氮、硫等元素的毒性蛋白，与蛇的神经毒素类似，但含硫量较高。此外，尚含三甲胺、甜菜碱、牛磺酸、卵磷脂及铵盐等。斑蝥（E错）【成分】南方大斑蝥主含斑蝥素0.427%～1.452%。此外，尚含羟基斑蝥素、脂肪油12%、树脂、蚁酸、色素等。